孕前保健的目的是
A. 了解婚配是否影响胎儿健康
B. 筛查妊娠危险因素
C. 遗传性疾病的产前检查
D. 选择适宜的受孕时机
E. 选择适宜的妊娠季节

正确答案：D。选择适宜的受孕时机

解析：本题考查孕前保健的目的。孕前保健指导的目的是使母亲能做到有计划、有准备地怀孕，预防和减少影响妇女健康和妊娠的不利因素，减少出生缺陷和先天残疾的发生，即选择适宜的受孕时机（D对ABCE错）。